患者面色赤，恶寒发热，肌肤灼热，语声高亢，呼吸气粗，口干渴饮，小便短赤涩痛，大便秘结，舌红绛，苔黄黑生芒刺，脉浮数，其临床意义是
A. 阳证
B. 阴证
C. 阳虚证
D. 阴虚证
E. 亡阳证

正确答案：A。阳证

解析：阳证是表证、热证、实证的归纳；恶寒发热并见为表证的特征；面色赤，肌肤灼热，口干渴饮为热证的表现；语声高亢，呼吸气粗、小便短赤涩痛，大便秘结是实证的表现；舌质红绛，苔黄黑生芒刺，脉浮数均为实热之征；故辨为阳证（A对）。阴证表现为面色苍白，精神萎靡，畏冷肢凉，倦怠无力，语声低怯，口淡不渴，小便清长或短少，大便溏泻，舌淡胖嫩，脉沉迟、微弱、细（B错）。阳虚证表现为畏寒，肢冷，口淡不渴，或喜热饮，或自汗，小便清长或尿少浮肿，大便稀薄，面色胱白，舌淡胖嫩，苔白滑，脉沉迟无力（C错）。阴虚证表现为形体消瘦，口燥咽干，两颧潮红，五心烦热，潮热盗汗，小便短黄，大便干结，舌红少津、少苔，脉细数等（D错）。亡阳证表现为冷汗淋漓，汗液稀淡，面色苍白，手足厥冷，肌肤不温，神情淡漠，呼吸气弱，舌质淡润，脉微欲绝等（E错）。